《献血法》共有
A. 21条
B. 22条
C. 23条
D. 24条
E. 25条

正确答案：D。24条

解析：《献血法》共有24条。掌握“无偿献血、医疗机构和血站职责及法律责任”知识点。